治疗艾滋病患者隐球菌性脑膜炎的首选药是
A. 利巴韦林
B. 氟康唑
C. 左氧氟沙星
D. 磺胺类药物
E. 四环素

正确答案：B。氟康唑

解析：氟康唑是治疗艾滋病的患者隐球菌性脑膜炎的首选药。掌握“氟康唑、利巴韦林及阿昔洛韦”知识点。